性温，既治咳嗽哮喘，又治小儿慢惊的药是
A. 竹沥
B. 洋金花
C. 瓦楞子
D. 百部
E. 礞石

正确答案：B。洋金花

解析：本题考查的是洋金花的主治病证。性温，既治咳嗽哮喘，又治小儿慢惊的药是洋金花（B对）。洋金花：【主治病证】（1）咳嗽哮喘。（2）小儿慢惊。（3）脘腹冷痛，风湿痹痛，外科麻醉。竹沥（A错）：【主治病证】（1）肺热之痰壅咳喘。（2）中风痰迷，惊痫癫狂。瓦楞子（C错）：【主治病证】（1）顽痰久咳，瘰疬，瘿瘤。（2）癥瘕痞块。（3）胃痛泛酸。百部（D错）：【主治病证】（1）新久咳嗽，百日咳，肺痨咳嗽。（2）蛲虫病，头虱，体虱。礞石（E错）：【主治病证】（1）顽痰、老痰胶结之气逆咳喘。（2）惊风抽搐，癫痫发狂。